阳水之风水相搏证的治法是
A. 疏风清热，宣肺行水
B. 宣肺解毒，利湿消肿
C. 健脾化湿，温阳利水
D. 温运脾阳，以利水湿
E. 分利湿热，攻下逐水

正确答案：A。疏风清热，宣肺行水

解析：阳水风水相搏为风邪袭表，肺气闭塞，通调失职，风遏水阻所致，治宜疏风清热，宣肺行水（A对）。宣肺解毒，利湿消肿为阳水湿毒浸淫证的治法（B错）。健脾化湿，温阳利水为阳水水湿浸渍证的治法（C错）。温运脾阳，以利水湿为阴水脾阳虚衰证的治法（D错）。分利湿热，攻下逐水为阳水湿热壅盛证的治法（E错）。